血压增高，向心性肥胖，满月脸，皮肤紫纹，最可能的诊断是
A. 肾动脉狭窄
B. 主动脉缩窄
C. 嗜铬细胞瘤
D. 原发性醛固酮增多症
E. 库欣综合征

正确答案：E。库欣综合征

解析：血压增高、向心性肥胖、满月脸、皮肤紫纹，为库欣综合征（E对）的典型表现。肾动脉狭窄（A错）主要表现为高血压，无向心性肥胖、满月脸等表现。主动脉缩窄（B错）主要表现为上肢血压增高，而下肢血压下降（P277），无满月脸、向心性肥胖等表现。嗜铬细胞瘤（C错）主要表现为高血压，无向心性肥胖、满月脸、皮肤紫纹。原发性醛固酮增多症（D错）主要表现为高血压、低血钾，无向心性肥胖、满月脸、皮肤紫纹。